对新生儿窒息进行复苏，最先施行的根本措施是
A. 药物治疗
B. 建立呼吸，增加通气
C. 维持正常循环，保证足够心排出量
D. 尽量吸净呼吸道粘液
E. 评价患儿病情

正确答案：D。尽量吸净呼吸道粘液

解析：新生儿窒息复苏采用国际公用的ABCDE复苏方案。A（airway）清理呼吸道（D对），B（breathing）建立呼吸，C（circulation）维持正常循环，D（drugs）药物治疗，E（evaluation）评估（ABCE错）。总结为儿童和婴儿的CPR程序为CAB，而婴儿常规为ABC（心脏原因者除外）。